下列关于氯丙嗪的临床应用，错误的是
A. 精神分裂症
B. 抑郁症
C. 放射治疗引起的呕吐
D. 严重创伤和感染的辅助治疗
E. 顽固性呃逆

正确答案：B。抑郁症

解析：氯丙嗪的临床应用：①精神分裂症（A对）②呕吐：治疗多种疾病（如癌症、放射病、尿毒症等）及药物（吗啡、洋地黄等）所引起的呕吐（C对）。氯丙嗪对于顽固性呃逆也有明显疗效（E对）。③温麻醉及人工冬眠：主要用于严重创伤、感染、高热惊厥、甲状腺危象、妊娠中毒及休克等（D对）（B错，为本题正确答案）。